方颅多见于
A. 3个月以内
B. 3～6个月
C. 6个月以上
D. 7～8个月以上
E. 12个月

正确答案：D。7～8个月以上

解析：方颅：多见于7～8个月以上小儿，由于骨样组织增生致额骨及顶骨双侧呈对称性隆起，形成方颅，重者可呈鞍状、十字状颅形。掌握“维生素D缺乏性佝偻病”知识点。